沙门菌属食物中毒的好发食品是
A. 奶及奶制品
B. 鱼虾蟹贝类等
C. 禽蛋类
D. 面包，面条等食品
E. 臭豆腐，豆酱等

正确答案：C。禽蛋类

解析：沙门菌属食物中毒食品种类：主要是动物性食品，特别是禽肉类及其制品，其次为禽肉、蛋类、奶类及其制品，由植物性食物引起的很少。掌握“食品安全”知识点。